调节溶液渗透压的方法有
A. 氯化钠等渗当量法
B. 氯化钠当量法
C. 冰点降低法
D. 饱和溶液法
E. pH降低法

正确答案：A、C。氯化钠等渗当量法；冰点降低法